某女，35岁，行经错后，经水量少，有血块，行经小腹疼痛，经前双乳胀痛，烦躁，食欲不振。治当养血舒肝、调经止痛，宜选用的成药是
A. 妇科十味片
B. 女金丸
C. 乌鸡白凤丸
D. 益母草颗粒
E. 少腹逐瘀丸

正确答案：A。妇科十味片

解析：本题考查妇科十味片的功能。治当养血舒肝、调经止痛，宜选用的成药是妇科十味片（A对）。妇科十味片【功能】养血舒肝，调经止痛。女金丸（B错）【功能】益气养血，理气活血，止痛。乌鸡白凤丸（C错）（片）【功能】补气养血，调经止带。益母草颗粒（D错）（膏、胶囊、片、口服液）【功能】活血调经。少腹逐瘀丸（E错）（颗粒、胶囊）【功能】温经活血，散寒止痛。